成熟DC最重要的功能是
A. 摄取抗原
B. 维持和诱导免疫耐受
C. 免疫调节作用
D. 杭原提呈与免疫激活作用
E. 加工抗原

正确答案：D。杭原提呈与免疫激活作用